《中国药典》2010年版一部规定应进行色度检查的药材是
A. 白术
B. 天麻
C. 人参
D. 白芍
E. 当归

正确答案：A。白术

解析：本题考查的是需色度检查的中药。《中国药典》2010年版一部规定应进行色度检查的药材是白术（A对）。色度检查：含挥发油或油脂类成分的中药，在贮藏过程中常发生氧化、聚合、缩合而致变色或“走油”。许多中药目前仅靠感官评判变色与“走油”程度，缺乏良好指标。《中国药典》规定检查白术的色度，就是利用白术的酸性乙醇提取液与黄色9号标准比色液比较，不得更深，用以检查有色杂质的限量，从量化的角度评价和控制其药材变色、走油变质的程度。天麻（B错）需检查二氧化硫残留量，规定二氧化硫残留量不得过400mg/kg。人参（C错）需要进行水分测定《中国药典》规定的水分限量，人参不得过12%。白芍（D错）需检查重金属及有害元素，含铅不得过5mg/kg，镉不得过0.3mg/kg，砷不得过2mg/kg，汞不得过0.2mg/kg，铜不得过20mg/kg；需检查二氧化硫残留量，规定二氧化硫残留量不得过400mg/kg。当归（E错）需要进行灰分测定，《中国药典》规定当归总灰分不得过7.0%，酸不溶性灰分不得过2.0%。